患者，女，45岁，消化性溃疡反复发作10年，剧烈腹痛突然发作3小时，全腹压痛反跳痛肌紧张，X线检查可见膈下游离气体，应诊断为
A. 急性胆囊炎
B. 急性胰腺炎
C. 急性肠梗阻
D. 急性腹膜炎
E. 胃十二指肠溃疡急性穿孔

正确答案：E。胃十二指肠溃疡急性穿孔

解析：患者，女，45岁，消化性溃疡反复发作10年，易进一步加重引起胃十二指肠溃疡穿孔，患者突发性上腹剧痛，体征：全腹压痛，反跳痛，以上腹部最明显，呈“板状腹”，X线检查可见膈下游离气体，诊断为胃十二指肠溃疡穿孔（E对）。胆囊炎典型临床特征为右上腹阵发性绞痛，伴有明显的触痛和腹肌强直（A错）。急性胰腺炎临床以急性上腹痛、恶心、呕吐、发热和血胰酶增高等为特点。病变程度轻重不等，轻者以胰腺水肿为主（B错）。肠梗阻临床表现为腹痛、呕吐、腹胀、停止排气排便（C错）。弥漫性腹膜炎主要临床表现为腹痛、腹部压痛腹肌紧张，以及恶心，呕吐，发烧，白血球升高，严重时可致血压下降和全身中毒性反应（D错）。